下列关于霍乱临床表现的叙述，错误的是
A. 典型大便为米泔水样
B. 成人一般无发热
C. 泻吐期主要为无痛性剧烈呕吐
D. 严重脱水出现烦躁不安
E. 恢复期所有患者出现反应性发热

正确答案：E。恢复期所有患者出现反应性发热

解析：1.泻吐期 持续数小时或2～3日不等。（1）腹泻 为本病的第一个症状，特点为无发热（B对）。最初粪便含粪质，后为黄色水样或"米泔水"样便（A对）。（2）呕吐 多发生在腹泻后，一般为喷射状，少有恶心（C对）。2.脱水期 严重失水导致的低血容量性休克，表现为四肢厥冷，脉搏细速，严重者不能触及，血压下降或不能测出。由于脑缺血而出现意识障碍，初期为烦躁不安（D对），继而出现呆滞、嗜睡甚至昏迷（E错，为本题正确答案）。